修复前如唇舌系带附着点接近牙槽嵴顶，影响义齿的固位应进行
A. 软组织加深术
B. 系带矫正术
C. 前庭沟加深术
D. 牙槽嵴修整术
E. 牙槽嵴重建术

正确答案：B。系带矫正术

解析：系带的修整：如唇舌系带附着点接近牙槽嵴顶，系带过短，影响义齿的固位和功能，则应进行外科修整。掌握“修复前准备”知识点。